细辛具有的功效是
A. 回阳救逆
B. 温肝暖肾
C. 温中降逆
D. 宣通鼻窍
E. 理气和胃

正确答案：D。宣通鼻窍

解析：该题考查细辛的功效，属记忆内容。细辛味辛，性温；入肺、肾、心经；具有解表散寒，祛风止痛，通窍，温肺化饮的功效（D对ABCE错）。